关于年轻恒牙治疗中注意事项，除外的是
A. 彻底清除根管内感染物质
B. 去除根管内牙髓时，应按照X线片测量的工作长度
C. 定期复查，定期换药
D. 牙髓或根尖周病变的程度是根尖诱导成形术的唯一制约因素
E. 应该尽量保留根尖部的生活牙髓

正确答案：D。牙髓或根尖周病变的程度是根尖诱导成形术的唯一制约因素

解析：年轻恒牙治疗中注意事项①彻底清除根管内感染物质是消除根尖周围炎症促使根尖形成的重要因素。②去除根管内牙髓时，应按照X线片测量的工作长度，用根管锉紧贴根管壁将牙髓碎片清除，避免将感染物质推出根尖或刺伤根尖部组织。③定期复查，定期换药，当X线片显示根尖周病变愈合、牙根继续发育并成形，或根管内探查根尖端有钙化物沉积时可进行常规根管治疗。④根尖诱导成形术的疗程和效果，不仅取决于牙髓或根尖周病变的程度，而且取决于牙根发育程度和患者健康状态。因此，治疗较为困难，疗程较长。⑤牙根未发育完全的牙齿，其根尖部的细胞具有潜在能力，炎症消除后能进行细胞分化，因此控制感染，去除感染非常重要。应该尽量保留根尖部的生活牙髓；保护牙乳头；恢复上皮根鞘功能。掌握“年轻恒牙牙髓病及根尖周病诊断及治疗”知识点。